女性一生要经过几个时期
A. 5个时期
B. 6个时期
C. 7个时期
D. 8个时期
E. 4个时期

正确答案：A。5个时期

解析：本题考查妇女的生命周期。在妇女的生命周期中，要经过女童期、青春期、生育期、更年期和老年期共5个时期（A对BCDE错）。